统计工作的步骤包括，除了
A. 搜集资料
B. 统计设计
C. 分析资料
D. 整理资料
E. 得出结论

正确答案：E。得出结论

解析：统计工作的基本步骤包括设计、搜集资料、整理资料和分析资料，此四个步骤是相互联系的。掌握“统计基本概念和步骤”知识点。